常用人体的哪部分骨骼判断骨骼的成熟程度
A. 手腕骨
B. 脚踝骨
C. 肩胛骨
D. 头颈骨
E. 腰椎骨

正确答案：A。手腕骨